选择性抑制延髓咳嗽中枢，并具有微弱的阿托品样作用，适用于各种原因引起的无痰干咳的药物是
A. 喷托维林
B. 苯丙哌林
C. 可待因
D. 右美沙芬
E. 羧甲司坦

正确答案：A。喷托维林

解析：本题考查喷托维林。选择性抑制延髓咳嗽中枢，并具有微弱的阿托品样作用，适用于各种原因引起的无痰干咳的药物是喷托维林（A对）。喷托维林兼有中枢和外周镇咳作用。①可直接抑制咳嗽中枢，镇咳强度为可待因的1/3；②有局麻作用，可抑制呼吸道感受器，有助于止咳；③有轻度阿托品样作用，有利于缓解支气管平滑肌痉挛。适用于上呼吸道炎症引起的干咳。苯丙哌林（B错）用于治疗急、慢性支气管炎及各种刺激引起的刺激性干咳。可待因（C错）适用于无痰剧烈干咳，对胸膜炎干咳伴胸痛患者尤为适用。右美沙芬（D错）用于各种原因引起的干咳，包括上呼吸道感染（如感冒和咽炎）、支气管炎等引起的咳嗽。羧甲司坦（E错）属于黏痰调节剂类祛痰药。